关于斜疝特点描述正确的是
A. 精索在疝囊前外方
B. 精索在疝囊后方
C. 很少发生嵌顿
D. 多见于老年人
E. 疝囊颈在腹壁下动脉的内侧

正确答案：B。精索在疝囊后方

解析：腹股沟斜疝是最常见的腹外疝，疝囊经腹股沟管深环突出，斜行经过腹股沟管，再由腹股沟管浅环穿出，并可进入阴囊。精索在疝囊后方（B对A错），疝囊颈在腹壁下动脉的外侧（E错）；回纳疝块后压住深环，疝块不再突出。斜疝多见于儿童及青壮年（D错），常表现为腹股沟区一梨形或椭圆形的肿块，易发生嵌顿（C错）。